休克期发生
A. 毛细血管前阻力增大
B. 毛细血管后阻力增大
C. 两者均有
D. 两者均无
E. 无

正确答案：B。毛细血管后阻力增大

解析：休克期即微循环淤血期，此期微动脉、后微动脉和毛细血管前括约肌收缩性减弱甚至扩张（即毛细血管前阻力减小）（A错），大量血液涌入真毛细血管网。微静脉虽也表现为扩张，但因血流缓慢，细胞嵌塞，使微循环流出道阻力增加（即毛细血管后阻力增大）（B对），毛细血管后阻力大于前阻力而导致血液淤滞于微循环中。